为西方医学道德奠基的代表作是
A. 《日内瓦宣言》
B. 《希波克拉底誓言》
C. 《迈蒙尼提斯祷文》
D. 《医德十二箴》
E. 《医德守则》

正确答案：B。《希波克拉底誓言》

解析：古希腊文化是西方文明的源头，伟大的医学家希波克拉底被称为西方医德的奠基人，其著名的《希波克拉底誓言》对医生之间、医患之间的行为准则作了较系统的阐述，成为西方医学道德奠基的代表作，主张医生应该爱人类，立志献身医学（B对）。